某女，28岁，症见痰多色白，胸闷胁痛，证属痰浊阻肺，肝郁气滞，当化痰、疏肝、理气，宜选用
A. 木香
B. 香附
C. 沉香
D. 佛手
E. 荔枝核

正确答案：D。佛手

解析：本题考查的是佛手的功效。症见痰多色白，胸闷胁痛，证属痰浊阻肺，肝郁气滞，当化痰、疏肝、理气，宜选用佛手（D对）。佛手：【功效】疏肝理气，和中，化痰。木香（A错）：【功效】行气止痛，健脾消食。香附（B错）：【功效】疏肝理气，调经止痛。沉香（C错）：【功效】行气止痛，温中止呕，温肾纳气。荔枝核（E错）：【功效】行气散结，祛寒止痛。